四块手蚓状肌接受的神经支配与下列肌的神经支配相同
A. 骨间背侧肌和骨间掌侧肌
B. 旋前圆肌和旋前方肌
C. 指浅屈肌
D. 指深屈肌
E. 尺侧腕屈肌和桡侧腕屈肌

正确答案：D。指深屈肌

解析：第1、2蚓状肌由正中神经支配，桡侧腕屈肌由正中神经支配，第3、4蚓状肌由尺神经支配，尺侧腕屈肌由尺神经支配（E对）。